男，4岁。因反复低热、咳嗽和盗汗15天就诊。查体：T37.5℃，右眼球结膜充血，内眦部有一疱疹，咽部充血，右颈部可触及黄豆大小淋巴结，无明显压痛，心肺无异常，肝肋下1.5厘米，血WBC5.6×10⁹/L，L0.70。最可能的诊断是
A. 结核感染
B. 咳嗽变异性哮喘
C. 肺炎支原体感染
D. 急性上呼吸道感染
E. 支气管异物

正确答案：A。结核感染

解析：肺炎（B错）、支原体感染（C错）、急性上呼吸道感染（D错）、支气管异物（E错）不会出现结核（低热和盗汗）的典型体征。另外还有右眼球结膜充血、右颈部可触及黄豆大小淋巴结、肝脏增大以及白细胞增高（以淋巴细胞增高为主）的临床症状，进一步可以确定是结核感染（A对）。